低分子药物溶解于溶剂中所形成的澄明液体制剂
A. 糖浆剂
B. 溶胶剂
C. 芳香水剂
D. 高分子溶液剂
E. 溶液剂

正确答案：E。溶液剂

解析：本题考查低分子溶剂。低分子药物溶解于溶剂中形成的澄明液体制剂为溶液剂（E对）；糖浆剂（A错）指含有药物、中药提取物或芳香物质的蔗糖水溶液，供口服应用；溶胶剂（B错）指固体药物细微粒子分散在水中形成的非均匀分散的液体制剂,又称疏水胶体溶液；芳香水剂（C错）为挥发油或其他挥发性芳香药物的饱和或近饱和澄明水溶液；高分子溶液剂（D错）指高分子化合物溶解于溶剂中制成的均匀分散的液体制剂。